患儿，女，2岁，半年来经常泄泻，形神疲惫，面色萎黄，大便稀薄，四肢不温，时有抽搐。其证候是
A. 土虚木亢
B. 外感惊风
C. 痰食惊风
D. 脾肾阳虚
E. 阴虚风动

正确答案：A。土虚木亢

解析：患儿于慢性腹泻过程中出现抽搐，伴形神疲惫，面色萎黄等症状，故诊断慢惊风。脾阳虚，中焦运化失司，气血生化乏源，不能温养肢体，故见经常泄泻，形神疲惫，面色萎黄，四肢不温；脾阳虚，不能温运水湿，水湿停滞于大肠，故见大便稀薄；脾虚肝旺，肝阳亢而生风，故见时有抽搐，故其证候为脾虚肝旺证，即土虚木亢（A对）。外感惊风（B错）证包括感受风邪证、感受暑邪证、感受疫邪证，表现为急性起病，发热、惊厥、抽搐等症，兼有相应病邪的致病特点。脾肾阳虚（D错）证临床以神昏、面白，手足蠕蠕震颤为特征。阴虚风动（E错）证临床以身热消瘦，五心烦热，肢体拘挛或强直，抽搐时作为特征。